患者，女，30岁，5个月前顺产一女婴，坚持母乳喂养。向药师咨询哺乳期安全用药问题。药师的下列建议中正确的有
A. 哺乳期用药应综合考虑药物对母亲和婴儿的影响，权衡利弊
B. 哺乳期应遵医嘱用药，不要随意停药或缩短疗程
C. 如果必须使用药物，应在哺乳后服药，并尽可能推迟下次哺乳时间
D. 停药5～6个半衰期后，在乳汁中的药物浓度很低
E. 哺乳期妇女避孕可选用口服避孕药

正确答案：A、B、C、D。哺乳期用药应综合考虑药物对母亲和婴儿的影响，权衡利弊；哺乳期应遵医嘱用药，不要随意停药或缩短疗程；如果必须使用药物，应在哺乳后服药，并尽可能推迟下次哺乳时间；停药5～6个半衰期后，在乳汁中的药物浓度很低

解析：本题考查哺乳期安全用药。哺乳期用药对策：①权衡利弊用药（A对）。②选择适当药物：选用危害较小的。③关注婴儿乳汁摄取的药量，对相对较安全的药物，应在哺乳后用药，并尽可能推迟下次哺乳时间（C对）。④加强用药指导，遵医嘱用药，不要随意停药或缩短疗程（B对。停止用药后恢复哺乳的时间应在5～6个半衰期后（D对）。哺乳期妇女避孕不可选用口服避孕药（E错）。